长期应用易使血钾升高的药物
A. 呋塞米
B. 丁苯氧酸
C. 利尿酸
D. 螺内酯
E. 氢氯噻嗪

正确答案：D。螺内酯

解析：螺内酯的利尿作用弱，起效缓慢而持久，其利尿作用与体内醛固酮的浓度有关，仅在体内有醛固酮存在时才发挥作用。对切除肾上腺的动物则无利尿作用。螺内酯是醛固酮的竞争性拮抗药。醛固酮从肾上腺皮质释放后，进入远曲小管细胞，调控Na+、K+转运。螺内酯及其代谢产物坎利酮（canrenone）结构与醛固酮相似，结合到胞质中的盐皮质激素受体，阻止醛固酮受体复合物的核转位，而产生拮抗醛固酮的作用。另外，该药也能干扰细胞内醛固酮活性代谢物的形成，影响醛固酮作用的充分发挥，表现出排Na+保K+的作用。掌握“保钾利尿药和渗透性利尿药”知识点。